根据Nenst公式，K⁺平衡电位与细胞内外K⁺浓度比值有关。在实验中，改变神经细胞外液中哪一项因素不会对静息电位的大小产生影响
A. K⁺浓度
B. Cl⁻浓度
C. 温度
D. pH
E. 缺氧

正确答案：B。Cl⁻浓度

解析：Cl⁻的跨膜移动几乎完全是被动的，Cl⁻在膜两侧的分布主要取决于跨膜电位，即跨膜电位是Cl⁻跨膜扩散的原因，而非其跨膜移动的结果，所以Cl⁻浓度（B错，为本题正确答案）的改变对静息电位大小不会有影响。静息电位接近于K⁺的平衡电位，细胞外液K⁺浓度（A对）升高则可使K⁺外流减少，静息电位减少（P35）。当低温（C对），酸中毒（D对），缺氧时（E对），钠泵活动受到抑制使其主动转运K⁺减少，造成细胞内外K⁺浓度差减小，静息电位值变小（P35）。